男，30岁。咳嗽1个月。咳少量白色黏痰，无痰中带血，无胸闷、发热。胸部X线片检查发现“胸腔积液”，为明确诊断行胸腔穿刺术，抽液100ml时患者出现头晕、心悸、胸闷、出冷汗症状，当即停止抽液，休息后好转。患者出现上述症状最可能的原因是
A. 低血容量休克
B. 胸膜反应
C. 并发气胸
D. 复张后肺水肿
E. 低血糖反应

正确答案：B。胸膜反应

解析：胸腔积液行胸腔穿刺术，抽液100ml时患者出现头晕、心悸、胸闷、出冷汗症状，当即停止抽液，休息后好转。患者出现上述症状最可能的原因是胸膜反应（B对）。复张后肺水肿（D错）是由于过快、过多抽液使胸腔压力骤降。表现为剧咳、气促、咳大量泡沫状痰，双肺满布湿啰音，PaO₂下降，X线显示肺水肿征。